乙型肝炎发病的时间分布是
A. 春季高峰
B. 冬春高峰
C. 夏季高峰
D. 夏秋高峰
E. 无季节高峰

正确答案：E。无季节高峰